根据违法行为的性质和危害程度的不同，法律责任分为
A. 赔偿责任、补偿责任、刑事责任
B. 经济责任、民事责任、刑事责任
C. 行政处分、经济补偿、刑事责任
D. 行政处罚、经济赔偿、刑事责任
E. 民事责任、行政责任、刑事责任

正确答案：E。民事责任、行政责任、刑事责任

解析：根据违法行为的性质和危害程度的不同，法律责任分为民事责任、行政责任、刑事责任（E对）。